胎头跨耻征阳性的初产妇于临产后检查，不可能出现的是
A. 子宫收缩力异常
B. 胎位异常
C. 胎头衔接
D. 胎膜早破
E. 出现病理缩复环

正确答案：C。胎头衔接

解析：胎头跨耻征阳性的初产妇临产检查胎头高于耻骨联合平面，故不可能出现胎头衔接（C错，为本题正确答案）。子宫收缩力异常（A对）的常见病因有头盆不称。头盆不称可影响胎头内旋转，形成胎位异常（B对）。头盆不称使胎先露部不能衔接，前羊膜囊所受压力不均，导致胎膜早破（D对）。头盆不称可因胎先露下降受阻，为克服阻力子宫强烈收缩，子宫体部肌肉增厚变短，子宫下段肌肉变薄拉长，在两者及形成环状凹陷，即出现病理缩复环（E对）。